组织液的生成主要取决于
A. 毛细血管血压
B. 有效滤过压
C. 血浆胶体渗透压
D. 淋巴回流
E. 组织液静水压

正确答案：B。有效滤过压